女性，17岁。进食时牙齿疼痛并伴发出血3个月余。口腔检查：患牙有大而深的龋洞，洞内有红色肉芽组织，触痛（-），探诊出血，欲与牙龈息肉鉴别还需检查
A. 牙松动度
B. X线片
C. 探诊牙周袋深度
D. 探查息肉的蒂部
E. 牙髓活力电测验

正确答案：D。探查息肉的蒂部

解析：本题考查牙髓息肉。女性，17岁。进食时牙齿疼痛并伴发出血3个月余。口腔检查：患牙有大而深的龋洞，洞内有红色肉芽组织，触痛（-），探诊出血，欲与牙龈息肉鉴别还需检查探查息肉的蒂部（D对）。当洞内遇有息肉时，应注意鉴别是牙髓息肉、牙周膜息肉和牙龈息肉。牙龈息肉多是在患牙邻面出现龋洞时，由于食物长期嵌塞加之患牙龋损处粗糙边缘的刺激，牙龈乳头向龋洞所形成的空间增生，形成息肉样肉芽组织；牙周膜息肉是在多根牙的龋损穿通髓腔后进而破坏髓室底，根分叉处的牙周膜因外界刺激而反应性增生，肉芽组织由髓底穿孔处长入连通髓腔的龋损内，洞口外观极像牙髓息肉。临床上进行鉴别时，先通过X线片观察患牙根分叉区髓室底影像的连续性，再用探针探查息肉的蒂部以判断息肉的来源。三者牙都无明显的松动度，因此不能用松动度鉴别（A错）。X线可观察患牙根分叉区髓室底影像的连续性，可诊断牙周膜息肉，无法诊断牙龈息肉（B错）。深牙周袋是牙周病变的典型症状，不能用来鉴别牙髓息肉和牙龈息肉（C错）。牙髓息肉为慢性牙髓炎，可残有部分活髓也可牙髓全部炎症，牙龈息肉牙髓电活力测试为正常（E错）。